男性，71岁吸烟患者。反复咳嗽、咳痰、气促40余年，胸闷、心悸2年，加重伴发热1周，昏睡3小时入院。入院后查体：BP140/90mmHg，嗜睡状，呼之能应，瞳孔等大等圆，对光反射存在，口唇发绀，双肺可闻及湿啰音，心率120次/分，早搏3次/分，下肢凹陷性水肿。假设上述诊断成立，补充体检时还可出现的最主要体征是
A. 心音强弱快慢不等
B. 心界向左下扩大
C. 心界向左、右两侧扩大
D. 肺动脉瓣区第二心音亢进
E. 心尖区可闻及3/6级粗糙吹风样全收缩期杂音

正确答案：D。肺动脉瓣区第二心音亢进

解析：患者为老年男性，有吸烟史（慢阻肺最重要的环境因素），反复咳嗽、咳痰、气促40余年，胸闷、心悸2年，加重伴发热1周，出现昏睡，下肢凹陷性水肿，考虑诊断为慢性阻塞性肺疾病急性加重期，并出现了肺心病（下肢凹陷性水肿为右心衰竭的表现）。肺心病患者有原发肺脏疾病的体征，还有肺动脉区第二心音亢进（D对），三尖瓣区闻及收缩期杂音，颈静脉怒张等。心音强弱快慢不等（A错）为房颤的临床表现。心界向左下扩大（B错）是左心增大的表现，肺心病的患者右心增大。心界向左右两侧扩大（C错）是扩张型心肌病及心包积液的表现。心尖区可闻及3/6级粗糙吹风样全收缩期杂音（E错）见于二尖瓣关闭不全的患者。